肝毒性大，对肝药酶影响大。药物相互作用多的抗真菌药是
A. 两性霉素
B. 卡泊芬净
C. 氟胞嘧啶
D. 阿糖胞苷
E. 酮康唑

正确答案：E。酮康唑

解析：本题考查酮康唑。肝毒性大，对肝药酶影响大。药物相互作用多的抗真菌药是酮康唑（E对）。酮康唑有严重的肝毒性，也因抑制皮质激素和睾酮的合成，产生男性乳房发育，因此目前已不再口服用药，仅局部用于敏感菌引起的皮肤、毛发、指（趾）甲感染和阴道假丝酵母病。两性霉素B（A错） 静脉滴注不良反应较多，主要为发热、寒战，有时出现呼吸困难、血压下降。长时间用药，约80%以上患者可出现不同程度的肾功能损害，如蛋白尿、管型尿、血尿、血尿素氮或肌酐值升高等。此外，还常见贫血、头痛、恶心、呕吐、全身不适、体重下降、注射局部静脉炎等。偶见血小板减少或轻度白细胞减少。使用时，应注意心电图、肝肾功能及血象变化。卡泊芬净（B错）是棘白霉素类抗真菌药，卡泊芬净最主要的不良反应依次为：畏寒、发热、静脉炎、腹泻、恶心、呕吐、头痛，该药还可能出现组胺反应，如出疹、面部水肿、潮红、支气管收缩、气急。当本品与环孢素同时使用时，本品的AUC会增加，患者的ALT和AST升高。氟胞嘧啶（C错）主要不良反应为骨髓抑制，导致白细胞和血小板减少；其他还有皮疹、恶心、呕吐、腹泻及严重的小肠结肠炎等。约5%的患者出现肝功能异常，但停药后即恢复。阿糖胞苷（D错）是干扰核酸生物合成的抗肿瘤药物，非抗真菌药物。